倍半油酸山梨醇酯在软膏基质中可作为
A. 乳化剂
B. 增溶剂
C. 防腐剂
D. 辅助乳化剂
E. 抗氧化剂

正确答案：A。乳化剂

解析：本题考查软膏剂的基质。倍半油酸山梨醇酯在软膏基质中可作为乳化剂（A对）。非离子表面活性剂脂肪酸山梨坦类：为W/O型乳化剂。常与O/W型乳化剂如聚山梨酯类合用于O/W型基质中，用于调节HLB值并使之稳定；或与高级脂肪醇等合用于W/O型基质中，能吸收少量水分，对皮肤黏膜刺激性小。如倍半油酸山梨醇酯。增溶剂（B错）：药物在水中因加入表面活性剂而溶解量增加的现象称为增溶。具有增溶作用的表面活性剂称为增溶剂。防腐剂（C错）：防腐剂是指能抑制微生物生长繁殖的化学物品，也称抑菌剂。药品生产过程中，为了防止制剂中微生物的生长繁殖，可根据各种剂型各个品种的不同要求，选用合适的防腐剂。阴离子表面活性剂一价皂：常用钠、钾、铵的氢氧化物或三乙醇胺等有机碱与脂肪酸（如硬脂酸）作用生成的新生皂配制软膏，为O/W型乳化剂。含有机氨皂的乳膏剂基质：处方中三乙醇胺与部分硬脂酸形成硬脂酸胺皂，为O/W型乳化剂。硬脂酸胺皂的碱性较弱，适于药用制剂。单硬脂酸甘油酯，乳化能力弱，是W/O型辅助乳化剂（D错），能增加油相的吸水能力。软膏剂油脂性基质：油脂类系从动物或植物得到的高级脂肪酸甘油酯及其混合物。受温度、光线、氧气或微生物等影响引起分解、氧化和酸败，可加抗氧剂（E错）和防腐剂改善。常用的有动物油、植物油、氢化植物油等。中药油膏常以麻油与蜂蜡熔合为基质。